中国药典检查对氨基水杨酸钠中的间氨基酚，采用的滴定液是
A. 氢氧化钠滴定液
B. 盐酸滴定液
C. 高氯酸滴定液
D. 亚硝酸钠滴定液
E. 乙二胺四醋酸滴定液

正确答案：B。盐酸滴定液